肩关节脱位时，肱骨头最容易脱出的方向是
A. 前方
B. 外侧
C. 内侧
D. 上方
E. 后方

正确答案：A。前方

解析：肩关节脱位可分为四种类型，即前脱位、后脱位、上脱位及下脱位。由于肱骨头较大，关节盂浅而小，关节囊松弛，其前下方组织薄弱，故肩关节前脱位最为常见（A对）。